对于输尿管结石引起梗阻而致的肾功能明显受损，应采取的措施是
A. 肾盂造瘘
B. 膀胱造瘘
C. 立刻使用利尿剂
D. 立刻中药排石
E. 输尿管切开取石

正确答案：E。输尿管切开取石

解析：肾盂造瘘利用肾造瘘管来引流肾盂，从而缓解肾盂的梗阻，改善肾功能。而此题为输尿管结石（A错）。膀胱造瘘是病人由于下尿路梗阻引起的尿潴留，排尿困难，适宜急性尿潴留患者，无法从尿道插入导尿管等（B错）。立刻使用利尿剂和中药排石由于是输尿管结石，且引起梗阻，此方法不适宜（CD错）。输尿管切开取石适用于输尿管结石合并输尿管梗阻性病变等（E对）。